不属于淋巴器官的是
A. 淋巴结
B. 胸腺
C. 脾
D. 扁桃体
E. 淋巴滤泡

正确答案：E。淋巴滤泡

解析：淋巴器官包括淋巴结、胸腺、脾和扁桃体，淋巴滤泡属于淋巴组织（E错，为本题正确答案）。